男性，62岁。近两月来常有吞咽困难，伴隐痛，但可进半流质饮食，自感体力不支，逐渐消瘦。经检查见食管病变位于主动脉弓到下肺静脉平面，该部位是食管解剖分段的
A. 颈段
B. 胸上段
C. 胸中段
D. 胸下段
E. 腹段

正确答案：C。胸中段

解析：临床上采用国际抗癌联盟食管分段标准：①颈段：自食管入口（环状软骨水平）至胸廓入口处（胸骨上切迹下缘）；②胸段：又分为上、中、下三段。胸上段从自胸廓入口至气管分叉平面；胸中段和下段为自气管分叉平面至胃食管交界处全长二等分。胸中段与胸下段食管的交界处接近下肺静脉平面处；③腹段：为食管裂孔至贲门。主动脉弓约平气管分叉处，故主动脉弓至下肺静脉平面属于食管解剖分段的胸中段（C对）。